选择固定桥基牙时不必考虑的因素是
A. 牙周膜
B. 牙槽骨
C. 根长
D. 根形态
E. 对侧牙的形态

正确答案：E。对侧牙的形态

解析：桥基牙的选择要考虑牙周膜面积、冠根比，根的外形与结构，和牙槽骨高度降低程度来选择，对侧牙齿的形态不是需要考虑的因素。掌握“固定桥的生理基础”知识点。